治疗风湿痹痛，筋脉拘挛及肺痈、肠痈，应选用的药物是
A. 威灵仙
B. 薏苡仁
C. 木瓜
D. 秦艽
E. 五加皮

正确答案：B。薏苡仁

解析：薏苡仁渗湿除痹，能舒筋脉，缓和拘挛，能治疗风湿痹痛，筋脉拘挛；本品清肺肠之热，排脓消痈，治疗肺痈、肠痈（B对）。威灵仙（A错）应用于风湿痹痛，骨鲠咽喉。木瓜（C错）主要应用于湿痹拘挛，腰膝关节酸重疼痛，脚气浮肿，暑湿吐泻。秦艽（D错）应用于风湿痹痛，筋脉拘挛，骨节疼痛，中风半身不遂，湿热黄疸，骨蒸潮热。五加皮（E错）应用于风湿痹症，筋骨痿软，小儿行迟，体虚乏力，水肿，脚气肿痛。